男，60岁，体检时B超发现左肾下段不均质的中等回声实性肿块，CT增强扫描显示左肾下段恶性肿瘤，直径3.5cm，右肾萎缩。最适宜得治疗是
A. 左肾切除术
B. 左肾动脉栓塞术
C. 左肾根治切除术
D. 密切观察
E. 左肾部分切除术

正确答案：E。左肾部分切除术

解析：老年男性患者，诊断为左丘肾下段恶性肿瘤，直径3.5cm，右肾萎缩丧失正常功能，需要尽快治疗以防向远处浸润扩散（D错）。故应选择的治疗方法是左肾部分切除术（E对），可保留左肾部分功能，提高患者的生存质量。左肾根治切除术（C错）是肾癌最主要的治疗方法，适用于对侧肾功能完好的患者。左肾切除术（A错）虽可用于肾癌治疗，但疗效不及根治性肾切除术，且未保留左肾残存组织功能。肾癌具有多药物耐药基因，对放射治疗及化疗不敏感，故左肾动脉栓塞术效果较差（B错）。